关于阿片类镇痛药，说法错误的是
A. 注意不良反应处理
B. 个体化给药
C. 按阶梯给药
D. 提倡无创给药
E. 可按时或按需给药

正确答案：E。可按时或按需给药

解析：本题考查疼痛控制原则。世界卫生组织（WHO）癌症三阶梯止痛原则是指按照患者疼痛的轻、中、重的程度分别选用第一、二、三阶梯的止痛药物。具体原则如下。（1）口服给药：能口服尽量口服，提倡无创的给药方式（D对）。（2）按时给药：不是按需给药（E错，为本题正确答案）。（3）按阶梯给药（C对）：按照疼痛的程度和性质选用不同阶梯的止痛药物。（4）用药个体化（B对）。（5）注意具体细节：如注意不良反应处理（A对）。